下列联合用药中属于有益的药物相互作用有
A. 氢氯噻嗪合用硝苯地平治疗高血压
B. 氢氯噻嗪合用秋水仙碱治疗痛风
C. 呋塞米合用阿米卡星注射治疗感染
D. 吲达帕胺合用卡托普利治疗高血压合并糖尿病
E. 氢氯噻嗪合用洛伐他汀治疗高脂血症

正确答案：A、D。氢氯噻嗪合用硝苯地平治疗高血压；吲达帕胺合用卡托普利治疗高血压合并糖尿病

解析：本题考查联合用药。利尿药氢氯噻嗪作为降压药与各类抗高血压药物配伍，均可起到增强降压效果，减少用药剂量和不良反应，起到利尿、消肿的作用。硝苯地平是二氢吡啶类钙拮抗剂抗高血压药物，和氢氯噻嗪合并用药可增强降压效果（A对）。痛风患者禁用利尿剂（氢氯噻嗪）（B错）。呋塞米属于强利尿剂，与氨基糖苷类抗生素配伍则可造成听神经和肾功能的不可逆损害（C错）。高血压合并糖尿病首先考虑使用ACEI或ARB；如需联合用药，应以ACEI或ARB为基础，加用利尿剂或二氢吡啶类CCB（D对）。氢氯噻嗪不用于治疗高脂血症（E错）。